关于蛋白质二级结构的叙述正确的是指
A. 氨基酸的排列顺序
B. 每一氨基酸侧链的空间构象
C. 局部主链的空间构象
D. 亚基间相对的空间位置
E. 每一原子的相对空间位置

正确答案：C。局部主链的空间构象

解析：蛋白质分子的结构分为一级、二级、三级和四级结构，后三者称为高级结构或空间构象。蛋白质一级结构是指蛋白质分子中从N端至C端的氨基酸排列顺序（A错）。蛋白质二级结构是指蛋白质分子中局部主链的空间构象（C对），并不涉及每一氨基酸侧链的空间构象（B错）。蛋白质三级结构是指整条肽链中全部氨基酸残基的相对空间位置，也就是整条肽链每一原子的相对空间位置（E错）。蛋白质四级结构是指蛋白质分子中各个亚基的空间排布及亚基接触部位的布局和相互作用，即亚基间相对的空间位置（D错）。